营养不良患儿皮下脂肪逐渐减少或消失，最后累及的部位是
A. 面颊部
B. 胸部
C. 腹部
D. 臀部
E. 四肢

正确答案：A。面颊部

解析：营养不良的早期表现（P65）是活动减少、精神较差、体重生长速度不增。随营养不良加重，体重逐渐下降，主要表现为消瘦。皮下脂肪层厚度是判断营养不良程度的重要指标之一。皮下脂肪消耗的顺序先是腹部（C错），其次为躯干、臀部（D错）、四肢（E错），最后为面颊（A对）。皮下脂肪逐渐减少以致消失，皮肤干燥、苍白、逐渐失去弹性、额部出现皱纹，肌张力渐减低、肌肉松弛、肌肉萎缩呈“皮包骨”时，四肢可有挛缩。而胸部（B错）在七八版教材未做明确说明，但其属于躯干部分，故不是最后累计的部位。